患者，男，右下颌下区肿物3个月，检查见右下颌下区表面皮肤正常，触诊柔软，与皮肤无粘连，无压痛，低头时肿物稍有增大，口内检查亦未见异常。手术中见囊腔内流出蛋清样黏稠液体。该病最佳的治疗方法为
A. 完整切除囊壁，加压包扎
B. 抽净囊液，加压包扎
C. 切除舌下腺，加压包扎
D. 切除下颌下腺，抽净囊液
E. 切除舌下腺，抽净囊液，加压包扎

正确答案：E。切除舌下腺，抽净囊液，加压包扎

解析：根治舌下腺囊肿的方法是切除舌下腺，残留部分囊壁不致造成复发。对于口外型舌下腺囊肿，可全部切除舌下腺后，将囊腔内的囊液吸净，在下颌下区加压包扎，而不必在下颌下区做切口摘除囊肿。掌握“舌下腺及唾液腺黏液囊肿”知识点。